患者男，45岁，因慢性尖周炎而行根管治疗，以甲酚甲醛换药五次，开始时疼痛有所减轻，但第五次封药时，患者仍感不适及疼痛，其原因可能为
A. 感染复发
B. 机体免疫力下降
C. 药物半抗原作用
D. 无菌操作不严格
E. 器械超出根尖孔

正确答案：C。药物半抗原作用

解析：本题考查致病机制-宿主对细菌感染的反应。换药次数过多导致药物性难治性根尖周炎，药物半抗原作用（C对）刺激根尖周组织，导致病变迁延不愈，疼痛持续存在。多次换药患者仍感不适及疼痛，疼痛一直存在，所以不是感染复发（A错）所致，因感染复发有疼痛减轻后再加重的过程。机体免疫力下降（B错）时疼痛会加剧，此病无加重现象。无菌操作不严格（D错）、器械超出根尖孔（E错）不会出现疼痛减轻，疼痛一般会持续存在并加重。